某医院未经批准新设医疗美容科，从外地聘请了一位退休外科医师担任主治，该院行为性质属于
A. 非法行医
B. 超范围行医
C. 正常医疗行为
D. 特殊情况
E. 开展新技术

正确答案：B。超范围行医

解析：医疗机构应当按照核准登记的诊疗科目开展诊断、治疗活动。需要改变诊疗科目的，应当按照规定的程序和要求，办理变更登记手续，未经允许不得擅自扩大业务范围。非法行医是指无医生执业资格从事诊疗活动，包括在医疗机构中从事诊疗活动和擅自开业从事诊疗活动，主体为人。该医院未经批准擅自开展医疗美容科，属于超范围行医（B对），不属于非法行医（A错）。最高人民法院《关于审理非法行医刑事案件具体应用法律若干问题的解释》规定，具有下列情形之一的，应认定“未取得医生执业资格的人非法行医（P251）”：①未取得或者以非法手段取得医师资格从事医疗活动的；②个人未取得《医疗机构执业许可证》开办医疗机构的；③被依法吊销医师执业证书期间从事医疗活动的；④未取得乡村医生执业证书，从事乡村医疗活动的；⑤家庭接生员实施家庭接生以外的医疗行为的。该退休外科医生重新被聘请从事医疗美容专业，有医师资格但超出诊疗科目，属超范围行医，也不属于非法行医。